强心苷治疗心力衰竭的药理学基础是
A. 抑制房室传导
B. 加强心肌收缩力
C. 抑制窦房结
D. 缩短心房的有效不应期
E. 加快房室传导

正确答案：B。加强心肌收缩力

解析：本题考查强心苷治疗心力衰竭的药理学基础。强心苷治疗心力衰竭的药理学基础是加强心肌收缩力（B对）。强心苷类药通过抑制衰竭心肌细胞膜上Na⁺，K⁺-ATP酶，使细胞内Na⁺水平升高，促进Na⁺-Ca²⁺交换，提高细胞内Ca²⁺水平，从而发挥正性肌力作用。